淋病的病原体是
A. 人乳头瘤病毒
B. 沙眼衣原体
C. 苍白螺旋体
D. 淋病奈瑟菌
E. 纤细螺旋体

正确答案：D。淋病奈瑟菌

解析：本题考查常见性传播疾病及其病原体。淋病的病原体是淋病奈瑟菌（D对ABCE错），主要相关疾病有：尿道炎、附睾炎、睾丸炎、不育；宫颈炎、子宫内膜炎、输卵管炎、盆腔炎症性疾病、不孕； 直肠炎、咽炎；新生儿结膜炎、角膜瘢痕等。